落日征可见于
A. 小头畸形
B. 维生素D缺乏（佝偻）病
C. 脑膜炎
D. 脑积水
E. 颅内出血

正确答案：D。脑积水

解析：落日征是由于颅内压增高，压迫眼球，形成双目下视，巩膜外露的特殊表情，可见于脑积水（D对）患者。小头畸形（A错）是由于小儿囟门过早闭合所致，此类患者常同时伴有智力发育障碍。维生素D缺乏（佝偻）病（B错）主要出现于儿童，表现为X型或O型腿、鸡胸等。脑膜炎（C错）主要表现为发热、头痛、呕吐等，一般不会出现落日征。颅内出血（E错）主要表现为头痛、呕吐等颅内压增高症状，严重者可出现昏迷、休克。